治疗肠易激综合征（腹泻型）的药物中应避免睡前服用的是
A. 匹维溴铵
B. 曲美布汀
C. 洛哌丁胺
D. 复方地芬诺酯
E. 蒙脱石散

正确答案：A。匹维溴铵

解析：本题考查匹维溴铵的使用。治疗肠易激综合征（腹泻型）的药物中应避免睡前服用的是匹维溴铵（A对）。匹维溴铵服用时切勿嚼碎、咀嚼，宜在进餐时用水吞服，不宜睡前吞服。曲美布汀（B错）、洛哌丁胺（C错）、复方地芬诺酯（D错）、蒙脱石散（E错）均可治疗肠易激综合征（腹泻型），睡前可以使用。